小儿身高85cm，头围48cm，乳牙20枚，能跳，能表达自己的意愿。按公式计算此小儿的体重约是
A. 16kg
B. 14kg
C. 12kg
D. 10kg
E. 8kg

正确答案：C。12kg

解析：小儿1岁时身长75cm，第2年身长生长速度减慢，约10～12cm，即2岁身长约87cm。小儿出生时头围平均33-34cm，1岁时头围46cm，生后第2年头围仅增长2cm，即2岁时头围48cm。乳牙一共20颗，大多于3岁前出齐。小儿运动发育可概括为“二抬四翻六会坐，七滚八爬周（周岁）会走，两岁会跳，三岁会跑”。根据以上可判断此小儿为2岁，小儿1岁时体重10kg，1～12岁体重＝年龄（岁）＊2+8 。此小儿2岁，体重应为12kg（C对）。